在病例对照研究中，选择对照的最佳条件是
A. 对照与病例必须来自同一人群
B. 未患所研究疾病的健康人
C. 对照可随研究人员随意选择
D. 产生病例人群中的非病者，其他非研究因素特征与病例组相同
E. 产生病例人群中的非病者，其他非研究因素特征与病例组有可比性

正确答案：E。产生病例人群中的非病者，其他非研究因素特征与病例组有可比性